触诊主动脉瓣狭窄患者心前区震颤的最佳部位是
A. 胸骨左缘3、4肋间
B. 心尖部
C. 胸骨左缘第2肋间
D. 剑突下
E. 胸骨右缘第2肋间

正确答案：E。胸骨右缘第2肋间

解析：震颤为触诊时手掌尺侧（小鱼际）或手指指腹感到的一种细小震动感。震颤的发生机制与心杂音相同，系血液经狭窄的口径或循环异常的方向流动形成涡流造成瓣膜、血管壁或心脏壁震动传至胸壁所致。发现震颤后应首先确定部位及来源，其次确定其处于心动周期中的时期，最后分析其临床意义。触诊主动脉瓣狭窄患者心前区震颤的最佳部位是胸骨右缘第2肋间（E对）。胸骨左缘3、4肋间（A错）收缩期震颤见于室间隔缺损。心尖部（B错）震颤见于二尖瓣疾病。胸骨左缘第2肋间（C错）震颤见于肺动脉瓣疾病。剑突下（D错）震颤无明显临床意义。